某交通警察，工龄10余年。上班时间主要是站在街上指挥交通，他长期工作最有可能引起的工作有关疾病是
A. 滑囊炎
B. 肩周炎
C. 下肢静脉曲张
D. 慢性肝炎
E. 慢性胃炎

正确答案：C。下肢静脉曲张

解析：交警常持久站立工作，瓣膜承受过度的压力，逐渐松弛，不能紧密关闭，从而引起下肢静脉曲张（C对）。滑囊炎（A错）以慢性滑囊炎多见，常与职业有关，如矿工的膑前滑囊炎、鹰嘴滑囊炎等，系关节处滑囊就用磨损导致。肩周炎（B错）多见于中老年妇女，主要表现为肩周疼痛，各方向活动受限，软组织退行变，长期过度活动，姿势不良所产生的慢性损伤为该病主要激发因素。